称“阳中之阳”的是
A. 心
B. 肺
C. 脾
D. 肝
E. 肾

正确答案：A。心

解析：心在五行属火，为阳中之阳（A对）。肺（B错）在五行属金，为阳中之阴。脾（C错）在五行属土，阴中至阴。肝（D错），五行属木，为阴中之阳。肾（E错），属水，为阴中之阴。